应激性溃疡形成的最基本条件是
A. 胆汁返流
B. 酸中毒
C. 胃粘膜缺血
D. 胃腔内H+向粘膜内的反向弥散
E. 碱中毒

正确答案：C。胃粘膜缺血

解析：胃粘膜缺血（C对）是应激性溃疡形成的最基本条件。